手-足-口病病原体为
A. 单一肠道病毒
B. 多种肠道病毒
C. 单一呼吸道病毒
D. 多种呼吸道病毒
E. 多种肠道、呼吸道病毒

正确答案：B。多种肠道病毒

解析：手-足-口病（HFMD）是一种儿童传染病，又名发疹性水疱性口腔炎。该病以手、足和口腔黏膜疱疹或破溃后形成溃疡为主要临床特征。其病原为多种肠道病毒。掌握“手-足-口病”知识点。